关于正常产褥期临床表现的叙述正确的是
A. 体温在产后24小时内一般升高超过38°C
B. 产后宫缩痛多见于初产妇
C. 产后1周以后出现褥汗
D. 产后1日子宫底略上升达脐平
E. 产后14日子宫底位于脐下两横指

正确答案：D。产后1日子宫底略上升达脐平

解析：产后体温（P222）多数在正常范围内，体温可在产后24小时内略升高，一般不超过38℃，可能与产程延长至，过度疲劳有关（A错）。产后宫缩痛（P222）是指在产褥早期因子宫收缩引起下腹部阵发性剧烈疼痛，于产后1～2日出现，持续2～3日自然消失，多见于经产妇（B错）。褥汗是指产后一周内皮肤排泄功能旺盛而排出的大量汗液。以夜间睡眠和初醒时更明显（C错）。胎盘娩出后，子宫圆而硬，宫底在脐下一指，于产后第一日略上升至脐平（D对）。于产后10日，子宫降至骨盆腔内，腹部检查触不到宫底所以产后14日子宫底位于盆腔内（E错）。